通过被调查者回忆24小时内各种食物摄入情况，获得个人每日食物摄入量，计算出能量和营养素摄入量的膳食调查方法是
A. 称重法
B. 记帐法
C. 膳食回顾法
D. 化学分析法
E. 食物频数法

正确答案：C。膳食回顾法

解析：本题考查膳食回顾法。膳食回顾法（C对ABDE错）是对被调查者连续3天各种主副食物摄入情况进行回顾调查（包括在外就餐），获得个人每日各种食物摄入量，根据食物成分表计算出能量和营养素的摄入量。成人在24小时内对所摄入的食物有较好的记忆，一般认为24小时膳食的回顾调查最易取得可靠的资料，简称24小时回顾法。